下列经选项中接触传播的微生物是
A. 水痘病毒
B. 麻疹病毒
C. 风疹病毒
D. 流行性腮腺炎病毒
E. 乙肝病毒

正确答案：E。乙肝病毒

解析：由接触传播的微生物与疾病。掌握“口腔医疗保健中的感染”知识点。